《中国药典》铁盐检查法使用的试剂有
A. 盐酸
B. 醋酸
C. 过硫酸铵
D. 硫氰酸铵
E. 氯化亚锡

正确答案：A、C、D。盐酸；过硫酸铵；硫氰酸铵